两性霉素B的作用机制是
A. 抑制细菌蛋白质合成
B. 抑制细菌代谢
C. 干扰细菌核酸代谢
D. 抑制细菌细胞壁合成
E. 干扰真菌细胞膜功能

正确答案：E。干扰真菌细胞膜功能

解析：本题考查两性霉素B的作用机制。真菌细胞膜含有大量固醇类物质，抗真菌药两性霉素B能与之结合进而干扰真菌细胞膜功能（E对）。抑制细菌蛋白质的合成（A错）的抗菌药包括氨基糖苷类、林可霉素类等。抑制细菌代谢（B错）的是磺胺类抗菌药物。干扰细菌核酸代谢（C错）的有喹诺酮类等。抑制细菌细胞壁合成（D错）的有头孢菌素类和青霉素类等。